利福平抗菌作用的原理是
A. 抑制依赖于DNA的RNA多聚酶
B. 抑制分枝菌酸合成酶
C. 抑制腺苷酸合成酶
D. 抑制二氢叶酸还原酶
E. 抑制DNA回旋酶

正确答案：A。抑制依赖于DNA的RNA多聚酶

解析：本题考查利福平的作用机制。利福平抗菌作用的原理是抑制依赖于DNA的RNA多聚酶（A对）。利福平的抗菌作用机制：抑制病原体依赖DNA的RNA聚合酶，与敏感菌依赖DNA的RNA聚合酶β亚单位牢固结合，抑制病原体RNA合成的起始阶段，抑制细菌RNA的合成。抑制分枝菌酸合成酶（B错）是利福平的作用机制。抑制腺苷酸合成酶（C错）是碘苷的作用机制。抑制二氢叶酸还原酶（D错）是甲氨蝶呤的作用机制。抑制DNA回旋酶（E错）是喹诺酮类药物的作用机制。